医疗机构临床用血原则不正确的是
A. 严格掌握输血指征
B. 不得浪费和滥用血液
C. 遵照合理、科学的原则
D. 一般不需要做输血记录
E. 严禁无输血适应证的输血

正确答案：D。一般不需要做输血记录

解析：医疗机构临床用血应当遵照合理、科学的原则，制定用血计划，不得浪费和滥用血液。医疗机构应当根据自己的规模，床位以及平均每天的用血量严格掌握输血指征，定期向当地血站提出自己的用血计划，同时做好输血记录。避免不必要的输血，严禁无输血适应证的输血。掌握“医疗机构临床用血管理、及法律责任”知识点。